因医疗机构的行为造成患者损害，应当承担侵权责任的情形是
A. 鉴于当时医疗水平的诊疗
B. 未经患者同意公开其病历资料
C. 未说服患者近亲属配合符合诊疗规范的诊疗
D. 医务人员在抢救生命垂危的患者等紧急情况下已经尽到合理诊疗义务
E. 患者认为医务人员没有尽到合理诊疗义务

正确答案：B。未经患者同意公开其病历资料

解析：《侵权责任法》规定，医疗机构及其医务人员应当对患者的隐私保密。泄露患者隐私或者未经患者同意公开其病历资料（B对），造成患者损害的，应当承担侵权责任。《侵权责任法》规定了3种情形，医疗机构不承担赔偿责任：①患者或者其近亲属不配合医疗机构进行符合诊疗规范的诊疗（C错）；②医务人员在抢救生命垂危的患者等紧急情况下已经尽到合理诊疗义务（D错）；③限于当时的医疗水平难以诊疗（A错）。